北方春季某百天婴儿被诊断为轻度佝偻病，为防止病情的发展，应采取的最切实可行的措施是
A. 添加肝泥
B. 添加全蛋
C. 每天口服钙800mg，连续服用1个月
D. 每天口服维生素D400IU，连续服用1个月
E. 晒太阳

正确答案：E。晒太阳